土壤污染的来源不包括
A. 大气污染物
B. 工业废水和生活废水
C. 固体废弃物
D. 化肥及农药的使用
E. 地质环境中区域性差异导致土壤中某些元素过高

正确答案：E。地质环境中区域性差异导致土壤中某些元素过高

解析：本题考查土壤污染的来源。土壤污染是指在人类生产和生活活动中排出的有害物质进入土壤中，超过一定限量，直接或间接地危害人畜健康的现象。土壤污染的来源包括：大气污染物（A对）、工业废水和生活废水（B对）、固体废弃物（C对）、化肥及农药的使用（D对）等。地质环境中区域性差异导致土壤中某些元素过高（E错，为本题正确答案）不是土壤污染的来源。